妇女保健的重点范围是
A. 妇科恶性肿瘤的防治
B. 生殖道感染及性传播疾病的防治
C. 预产期保健及其疾病的防治
D. 妇女从青春期到更年期生殖器官与功能的保健及疾病的防治
E. 青春期、围产期、更年期保健

正确答案：D。妇女从青春期到更年期生殖器官与功能的保健及疾病的防治

解析：本题考查妇女保健的重点范围。妇女保健的重点范围是从女性青春期到更年期生殖器官与功能发育开始到生殖功能衰退的的保健，包括对女性生理、疾病与失调，影响妇女健康的心理、社会和环境相关因素的研究和保健（D对ABCE错）。